由下丘脑产生的激素是
A. 泌乳素
B. 促肾上腺皮质激素
C. 血管紧张素
D. 生长激素
E. 血管加压素

正确答案：E。血管加压素

解析：由下丘脑产生的激素包括：促甲状腺激素释放激素、促性腺激素释放激素、生长抑素、生长激素释放激素、促肾上腺皮质激素释放激素、催乳素释放因子、催乳素抑制因子、血管升压素（血管加压素、抗利尿激素）（E对）、缩宫素。泌乳素（催乳素）（A错）、促肾上腺皮质激素（B错）、生长激素（D错），由腺垂体分泌。血管紧张素（C错）是由肝生成的血管紧张素原水解而来。